光化学烟雾的主要成分是
A. O₃
B. 颗粒物
C. SO₂
D. NOₓ
E. 多环芳烃

正确答案：A。O₃

解析：本题考查光化学烟雾的主要成分。光化学烟雾是汽车、工厂等污染源排入大气的碳氢化合物（HC）和氮氧化物（NOx）等一次污染物在阳光（紫外光）作用下发生光化学反应生成二次污染物后与一次污染物混合所形成的有害浅蓝色烟雾。其主要成分是O₃（A对BCDE错）。